能通过细菌滤器，严格细胞内寄生，并有独特的发育周期的原核细胞型微生物
A. 支原体
B. 细菌
C. 真菌
D. 病毒
E. 衣原体

正确答案：E。衣原体

解析：衣原体是能通过细菌滤器，严格细胞内寄生，并有独特发育周期的原核细胞型微生物，革兰氏染色阴性。掌握“衣原体”知识点。